不属于骨迷路的结构是
A. 前庭
B. 耳蜗
C. 骨半规管
D. 蜗轴
E. 无

正确答案：D。蜗轴

解析：骨迷路是颞骨岩部骨密质围成的不规则腔隙,，分为耳蜗（B对）、前庭（A对）和骨半规管（C对，故D为本题正确答案）3部分。